在上丘平面不能看到的结构是
A. 中脑导水管
B. 大脑脚
C. 外侧丘系
D. 黑质
E. 中脑被盖

正确答案：C。外侧丘系

解析：在上丘平面不能看到的结构是外侧丘系（C对），因外侧丘系从中脑进入下丘，大部分纤维已终止换元；小部分纤维则经下丘臂止于内侧膝状体，再次换元并最终止于大脑听觉中枢，因而外侧丘系不经过上丘。在上丘平面可以看到的结构包括中脑导水管（A错）、大脑脚（B错）、黑质（D错）、中脑被盖（E错）。